位于膝关节囊内侧的是
A. 前交叉韧带
B. 胫侧副韧带
C. 翼状褽
D. 半月板
E. 髌韧带

正确答案：B。胫侧副韧带

解析：胫侧副韧带（B对）位于膝关节囊内侧，前交叉韧带（A错）和半月板（D错）位于内部，髌韧带（E错）位于关节囊前下方。